男性患儿，出生后表现持续性鹅口疮，9个月后因真菌性肺炎死亡。尸检发现其胸腺发育不全。此患儿发生持续感染主要由于
A. 继发性免疫缺陷
B. 细胞免疫缺陷
C. 体液免疫缺陷
D. 吞噬细胞缺陷
E. 补体系统缺陷

正确答案：B。细胞免疫缺陷

解析：患儿出生后表现持续性鹅口疮，9个月后因真菌性肺炎死亡，表明患儿体内免疫系统存有缺陷。尸检发现其胸腺发育不全（胸腺是T淋巴细胞发育和成熟的场所），导致T淋巴细胞缺乏及发育成熟障碍。缺乏T细胞，导致细胞免疫缺陷（由T淋巴细胞介导的免疫应答也称细胞免疫应答）（B对），极易反复发生病毒性和真菌性感染，甚至死亡。继发性免疫缺陷（A错）是由后天因素造成的、继发于某些疾病或使用药物后产生的免疫缺陷病，引起继发性免疫缺陷的原因有非感染因素如营养不良、恶性肿瘤等及感染性因素包括某些病毒、细菌和寄生虫等。导致继发性免疫缺陷病的常见病原微生物有：人类免疫缺陷病毒、麻疹病毒、风疹病毒、巨细胞病毒、EB病毒以及结核分枝杆菌、麻风杆菌等。体液免疫缺陷（C错）和吞噬细胞缺陷（D错）、补体缺陷（E错）时，常以化脓性细菌感染为主。